以下哪个指标不受年龄构成的影响
A. 粗死亡率
B. 某病死亡率
C. 平均死亡年龄
D. 总和生育率
E. 总生育率

正确答案：D。总和生育率